下列哪种脱氧核苷酸不是DNA的组分
A. dTMP
B. dCMP
C. dGMP
D. dUMP
E. dAMP

正确答案：D。dUMP